不属于不寐临床表现的是
A. 入睡困难
B. 寐而不酣
C. 时寐时醒
D. 寐而难醒
E. 彻夜不寐

正确答案：D。寐而难醒

解析：不寐是以经常不能获得正常睡眠为特征的一类病证，主要表现为睡眠时间、深度的不足，轻者入睡困难（A对），或寐而不醋（B对），时寐时醒（C对），或醒后不能再寐，重则彻夜不寐（E对）。寐而难醒（D错，为本题正确答案）多为昏睡或昏迷，属意识障碍。